临床用于治疗高血压和心力衰竭的药物是
A. 可乐定
B. 吲达帕胺
C. 依那普利
D. 甲基多巴
E. 米诺地尔

正确答案：C。依那普利

解析：本题考查依那普利。依那普利（C对）为血管紧张素转化酶抑制药（ACEI），临床用于各期原发性高血压、肾性高血压、恶性高血压及充血性心力衰竭。可乐定（A错）通过激活血管运动神经中枢α₂受体，减少交感神经冲动传出而降低血压。吲达帕胺（B错）为噻嗪样利尿药，临床用于治疗高血压。甲基多巴（D错）是中枢性降压药。米诺地尔（E错）为钾通道开放药，临床用于严重的原发性高血压或肾性高血压。